属于水不溶性包衣材料是
A. 醋酸纤维素
B. 羟丙基甲基纤维素
C. 丙烯酸Ⅱ号
D. 川蜡
E. 邻苯二甲酸二丁酯

正确答案：A。醋酸纤维素

解析：本题考查片剂的包衣。醋酸纤维素（A对）属于水不溶性包衣材料；羟丙基甲基纤维素（B错）为胃溶型包衣材料；丙烯酸Ⅱ号（C错）为肠溶型薄膜包衣材料；川蜡（D错）为打光剂；邻苯二甲酸二丁酯（E错）为增塑剂。